免疫耐受分为
A. 初次耐受及终次耐受
B. 中枢耐受及外周耐受
C. 简单耐受及复杂耐受
D. 直接耐受及间接耐受
E. 一次耐受及二次耐受

正确答案：B。中枢耐受及外周耐受

解析：免疫耐受分为中枢耐受及外周耐受。诱导免疫耐受的主要机制是克隆清除和克隆无能。掌握“免疫耐受”知识点。